异烟肼抗结核杆菌的作用机制是
A. 抑制细菌分枝杆菌酸的合成
B. 影响细菌胞质膜的通透性
C. 抑制细菌核酸代谢
D. 抑制细菌细胞壁的合成
E. 抑制DNA螺旋酶

正确答案：A。抑制细菌分枝杆菌酸的合成

解析：本题考查异烟肼的作用机制。异烟肼抗结核杆菌的作用机制是抑制细菌分枝杆菌酸的合成（A对）。异烟肼的作用机制尚未完全阐明，其杀菌作用可能通过多种方式进行，如抑制细菌分枝杆菌酸的合成、干扰酶活性、影响DNA合成。